上腹部汽车撞伤4小时，患者面色苍白，四肢厥冷，脉搏140次/分，血压60/40mmHg，全腹轻度压痛，肌紧张及反跳痛，首先考虑为
A. 胃破裂
B. 十二指肠破裂
C. 肝脾破裂
D. 严重的腹壁软组织损伤
E. 腹膜后血肿

正确答案：C。肝脾破裂

解析：患者上腹部外伤后，面色苍白，四肢厥冷（失血的表现），全腹轻度压痛，肌紧张及反跳痛（腹膜刺激症状轻微，可排除空腔脏器损伤），脉搏140次/分（正常为60～100次/分），血压60/40mmHg（正常范围为90～139/60～89mmHg，脉率加快、血压下降提示腹腔实质性脏器破裂出血），结合患者病史和体查，首先考虑肝、脾破裂（C对）。胃破裂（A错）、十二指肠破裂（B错）主要表现为弥漫性腹膜炎，由于出血量较少，失血症状多不明显。严重的腹壁软组织损伤（D错）主要表现为腹壁局部疼痛、肿胀、出血，压痛明显，无休克及腹膜刺激症状。腹膜后血肿（E错）以腰背痛、肠麻痹和失血症状为突出表现，部分患者可有髂腰部瘀斑（Grey Turner征），一般无腹膜刺激症状。